体质较强的症瘕患者，其治法是
A. 破瘀散结
B. 理气行滞
C. 先攻后补
D. 攻补兼施
E. 先补后攻

正确答案：C。先攻后补

解析：体质较强的患者，在患病时正气充足，邪气亦过盛，故治疗时可先攻邪气，在此期间会对正气有所耗损，因此补正气（C对）。破瘀散结多用于体内血行瘀滞，阻滞经脉气血运行所造成的癥瘕，是具体的治则（A错）。理气行滞多用于气滞所导致的癥瘕（B错）。攻补兼施多用于邪盛正虚之体（D错）。先补后攻无此说法（E错）。